女，68岁。高血压病史20年，发现尿蛋白3年，尿比重1.010，红细胞0～1/HP，尿蛋白0.45g/d。尿蛋白分析β₂-MG、α₁-MG升高，该患者蛋白尿属于
A. 组织性
B. 溢出性
C. 肾小管性
D. 功能性
E. 肾小球性

正确答案：C。肾小管性

解析：老年女性患者，高血压病史20年（长期高血压可以引起肾小动脉硬化，导致肾脏受损，肾功能减退），尿蛋白3年，尿蛋白0.45g/d（正常为0～0.08g/d，提示尿蛋白增加），尿蛋白分析β₂-MG（β₂微球蛋白）、αl-MG（α₁微球蛋白）升高（可以正常滤过的小分子量蛋白质增加），判断该患者蛋白尿属于肾小管性（C对）。肾小管性蛋白尿是指肾小管结构或功能受损，对正常滤过的小分子量蛋白质（如β₂-MG、αl-MG、溶菌酶等）重吸收障碍，形成的以β₂-MG、αl-MG等为主的蛋白尿。组织性蛋白尿（八版诊断学P312）（A错）多见低相对分子质量蛋白质，以T-H糖蛋白为主要成分。溢出性蛋白尿（八版内科学P461）（B错）以多发性骨髓瘤轻链蛋白、血红蛋白、肌红蛋白等增多为主。功能性蛋白尿（八版内科学P460）（D错）是生理性蛋白尿的一种，见于剧烈运动、发热、紧张等应激状态所导致的一过性蛋白尿。肾小球性蛋白尿（八版内科学P461）（E错）中，选择性蛋白尿以白蛋白为主，非选择性蛋白尿除中小分子量蛋白质外，可见大分子量蛋白质，如IgG。